下列各项中，不属于表情肌范畴的是
A. 颧大肌
B. 提上唇肌
C. 提口角肌
D. 颏肌
E. 咬肌

正确答案：E。咬肌

解析：咬肌属于咀嚼肌范畴。掌握“表情肌、舌腭肌”知识点。